女婴，10个月。动作发育倒退2个月。人工喂养，未正规添加辅食。查体：面色蜡黄，哭时无泪，舌颤。最可能的诊断是
A. 营养性维生素D缺乏性佝偻病
B. 营养性巨幼细胞性贫血
C. 缺铁性贫血
D. 蛋白质－能量营养不良
E. 脑性瘫痪

正确答案：B。营养性巨幼细胞性贫血

解析：女婴患者，动作发育倒退2个月。人工喂养，未正规添加辅食。查体：面色蜡黄，哭时无泪，舌颤。综合患者的症状、体征，最可能的诊断是营养性巨幼细胞性贫血（B对）。营养性维生素D缺乏性佝偻病（A错）多无面色蜡黄及舌颤的表现，多有串珠、手足镯、方颅、肋膈胸等表现。缺铁性贫血（C错）可见反甲。蛋白质－能量营养不良（D错）多有体重下降、身高增长缓慢、消瘦、水肿等症状，多无面色蜡黄及舌颤的表现。脑性瘫痪（E错）多无面色蜡黄及舌颤的表现。